女，35岁。右下腹痛、便秘1年。查体：T36.5℃，P80次/分，R16次/分，BP110/70mmHg。双肺呼吸音清，未闻及干湿性啰音，心率齐，腹软，无压痛。结肠镜检查：回肠末端及升结肠起始部多发纵行溃疡，溃疡间间黏膜大致正常，病变呈节段性。PPD试验阴性。最可能的诊断是
A. 克罗恩病
B. 阿米巴肠病
C. 肠结核
D. 溃疡性结肠炎
E. 结肠癌

正确答案：A。克罗恩病

解析：患者青年女性，右下腹痛、便秘1年（慢性病史）。查体无异常。结肠镜检查见回肠末端及升结肠起始部多发纵行溃疡，溃疡间黏膜大致正常，病变呈节段性（克罗恩病病理特点）。PPD试验阴性（结核菌素试验阴性，排除肠结核）。根据患者病史、临床表现、体格检查、实验室检查，诊断患者为克罗恩病。克罗恩病（A对）是一种慢性炎性肉芽肿性疾病，多见于末段回肠和邻近结肠，但从口腔至肛门各段消化道均可受累，呈阶段性或跳跃式分布。临床以腹痛、腹泻、体重下降、腹块、瘘管形成和肠梗阻为特点，可伴有发热等全身表现以及关节、皮肤、眼、口腔黏膜等肠外损害。重症患者迁延不愈，预后不良（P377）。阿米巴肠病（B错）病变主要在近端结肠和盲肠，结肠镜可见烧瓶样溃疡，有果酱样黏液脓血便（八版传染病学P272）。肠结核（C错）有长期不规则低热，结肠镜见回盲部等处黏膜充血水肿，横行溃疡，结核菌素PPD试验强阳性（P368）。溃疡性结肠炎（D错）多为左下腹痛，脓血便多见，结肠镜见黏膜溃疡弥漫性糜烂和多发性浅表溃疡（P374）。右侧结肠癌以全身症状、贫血和腹部包块为主要表现，左侧结肠癌以便血、腹泻、便秘和肠梗阻等症状为主。结肠镜见隆起或平坦型的肿瘤样改变，无节段性、多发纵行溃疡（E错）（P382）。